女，42岁。双手指间关节疼痛半年。左腕关节肿痛4周，査体：左腕关节肿胀，压痛（+），双手第2、4、5近端指间关节压痛（+），无肿胀。化验：ESR45mm/h，CRP187mg/L（正常＜8mg/L），RF（-），抗CCP抗体152RU/ml（正常＜5RU/ml）。该患者首先考虑的诊断是
A. 强直性脊柱炎
B. 风湿性关节炎
C. 系统性红斑狼疮
D. 类风湿关节炎
E. 骨关节炎

正确答案：D。类风湿关节炎

解析：中年女性患者（类风湿关节炎好发人群），双手指间关节疼痛半年、左腕关节肿痛4周，查体左腕关节肿胀，压痛阳性，双手第2、4、5近端指间关节压痛阳性（类风湿关节炎常见表现），抗CCP抗体阳性（对于类风湿关节炎诊断特异性高），考虑诊断为类风湿性关节炎（D对）。强直性脊柱炎（A错）主要见于青年男性，最典型及常见表现为下腰背部疼痛，抗CCP抗体阴性。风湿性关节炎（B错）以膝、踝、肘、腕、肩等大关节受累为主，呈游走性、多发性，关节疼痛很少持续一个月以上，通常在2周内消退。系统性红斑狼疮（C错）常出现在指、腕、膝关节，伴红肿者少见，且有关节外的系统症状如蝶形红斑等。骨关节炎（E错）多见于中老年人，主要累及远端指关节，RF及自身抗体均为阴性。